对新建、改建、扩建和续建的建设项目，在可行性研究、设计、施工和投产验收时，卫生部门需要对这些项目中的劳动卫生防护设施进行监督，这种工作称为
A. 卫生执法
B. “四同时”
C. 经常性卫生监督
D. 预防性卫生监督
E. 一般性卫生监督

正确答案：D。预防性卫生监督

解析：本题考查预防性卫生监督。对新建、改建、扩建和续建的建设项目，在可行性研究、设计、施工和投产验收时，卫生部门需要对这些项目中的劳动卫生防护设施进行监督，这种工作称为预防性卫生监督（D对ABCE错）。